关于大脑镰的位置
A. 在大脑半球与小脑之间
B. 在大脑半球之上
C. 在大脑半球之下
D. 包着大脑半球
E. 在大脑半球之间,大脑纵裂内

正确答案：E。在大脑半球之间,大脑纵裂内

解析：大脑镰呈镰刀形伸入大脑纵裂内，在大脑半球之间分隔两大脑半球（E对）。